智商IQ的结论“低能”是指其分数为
A. 70～79
B. 80～89
C. 90～109
D. 110～119
E. 120～129

正确答案：A。70～79

解析：本题考查智力水平的分级。智商IQ的结论“低能”是指其分数为70～79（A对）。70~85（B错）为智力边界值。85~115为智力平常值（CD错）。115~130为智力超常值（E错）。